苯巴比妥急性中毒时，可加速其在尿中排泄的药物是
A. 氯化铵
B. 碳酸氢铵
C. 葡萄糖
D. 生理盐水
E. 硫酸镁

正确答案：B。碳酸氢铵

解析：本题考查药物的排泄。碳酸氢铵（B对）在苯巴比妥急性中毒时，可加速其在尿中排泄。碳酸氢铵为弱碱性，可碱化尿液，苯巴比妥为弱酸性，在碱性尿中可加速排泄；氯化铵（A错）、葡萄糖（C错）、硫酸镁（E错）均为弱酸性，生理盐水（D错）为中性，不能碱化尿液。